流行病学研究方法包括
A. 实验法
B. 数理法
C. 观察法
D. A+C
E. A+B+C

正确答案：E。A+B+C

解析：流行病学研究方法：观察法（包括描述流行病学与分析流行病学）、实验法、数理法（理论流行病学）。掌握“流行病学概论”知识点。